消渴之下消证，若出现阴阳气血俱虚证，治疗应首选
A. 补中益气汤
B. 六味地黄丸
C. 归脾汤
D. 鹿茸丸
E. 金匮肾气丸

正确答案：D。鹿茸丸

解析：鹿茸丸功能气血阴阳俱补，主治消渴之下消证之阴阳气血俱虚证（D对）。补中益气汤功用补气健脾，升清降浊，主治痞满虚痞之脾胃虚弱证（A错）。六味地黄丸功能滋阴固肾，主治消渴下消证之肾阴亏虚证（B错）。归脾汤功能益气养血，主治内伤发热之血虚发热证（C错）。金匮肾气丸功能滋阴温阳，补肾固涩，主治消渴下消证之阴阳两虚证，（E错）。